一年轻妇女正常阴道分娩刚结束，检查胎盘和脐带时，应注意符合下列哪种情况才是正常的
A. 1条动脉，1条静脉
B. 1条动脉，2条静脉
C. 2条动脉，1条静脉
D. 2条动脉，2条静脉
E. 以上都不是

正确答案：C。2条动脉，1条静脉

解析：脐带是连接胎儿与胎盘的条索状组织，一端连于胎儿腹壁脐轮，另一端附着于胎盘胎儿面。①妊娠足月胎儿的脐带长30～100cm，平均约55cm，直径0.8～2.0cm，表面有羊膜覆盖呈灰白色。②脐带断面中央有一条脐静脉，两侧有两条脐动脉。掌握“妊娠生理”知识点。